肝炎病毒的传播途径不包括
A. 粪-口途径
B. 血液途径
C. 接触途径
D. 呼吸道途径
E. 垂直传播

正确答案：D。呼吸道途径

解析：甲型肝炎经粪-口途径传播；乙型肝炎传播途径可经血液、血制品、母-婴传播、性接触传播；丙型肝炎与乙型肝炎的传播途径相似，但其母婴传播率较低，主要经输血、脏器移植、血液透析、血制品及污染注射器等传播；HDV和HBV传播途径也相同；戊型肝炎主要经粪-口途径传播。掌握“丙型、丁型、戊型肝炎病毒”知识点。